男，60岁，突发持续性胸痛5小时，查体BP100/50mmHg，心率40次/分，律齐，心电图示急性下壁、右室心肌梗死，三度房室传导阻滞。最适宜的治疗措施是
A. 静脉滴注异丙肾上腺素
B. 静脉滴注肾上腺素
C. 静脉滴注多巴酚丁胺
D. 植入临时心脏起搏器
E. 植入永久心脏起搏器

正确答案：D。植入临时心脏起搏器

解析：患者为三度房室传导阻滞，心率40次/分（正常值60～100次/分），最适宜植入临时心脏起搏器（D对）。静脉注射异丙肾上腺素、静脉滴注肾上腺素（AB错）适用于任何部位的房室阻滞，但对急性心肌梗死时应十分慎重，因可能导致严重室性心律失常。静脉滴注多巴酚丁胺（C错）适用于心力衰竭的治疗。植入永久心脏起搏器（E错）适用于Ⅲ度房室传导阻滞无好转迹象或持续时间超过7日以上者。